下面关于循证医学证据的论述正确的是
A. 传统的医学实践是不讲证据的，循证医学实践则是讲证据的
B. 传统的医学实践是基于证据的，循证医学实践也是基于证据的，它们所基于的证据相同。
C. 传统医学实践是基于证据的，循证医学实践也是基于证据的，它们所基于的证据不同。传统医学基于经验证据，循证医学基于科学研究的现有的最好的证据，而不会考虑病人的情况或临床经验。
D. 传统医学实践是基于证据的，循证医学实践也是基于证据的，它们所基于的证据不同。传统医学基于经验证据，循证医学基于科学研究的现有的最好的证据，但也要根据临床经验和病人的情况做出合适的决定。
E. 以上都不对

正确答案：D。传统医学实践是基于证据的，循证医学实践也是基于证据的，它们所基于的证据不同。传统医学基于经验证据，循证医学基于科学研究的现有的最好的证据，但也要根据临床经验和病人的情况做出合适的决定。

解析：本题考查传统医学和循证医学的区别。传统医学实践是基于证据的，循证医学实践也是基于证据的，它们所基于的证据是不同的。传统医学基于经验证据，循证医学基于科学研究的现有的最好的证据，但也要根据临床经验和病人的情况做出合适的决定（D对ABCE错）。